男，68岁，既往有慢性支气管炎病史10年，一周前因感冒后咳嗽加重来诊，查体：神志模糊，两肺哮鸣音，心率110次/分，血气分析pH7.30，PaO₂50mmHg，PaCO₂80mmHg.下列治疗措施正确的是
A. 静脉滴注尼可刹米
B. 静脉注射毛花苷丙
C. 静脉滴注4%碳酸氢钠
D. 静脉注射呋塞米（速尿）
E. 人工机械通气

正确答案：E。人工机械通气

解析：患者老年男性，既往有慢性支气管炎病史10年，一周曾患感冒（提示前驱感染病史），咳嗽加重，神志模糊，两肺哮鸣音，血气分析pH7.30（正常值7.35～7.45），PaO₂50mmHg（正常值＞60mmHg），PaCO₂80mmHg（正常值35～45mmHg），支持Ⅱ型呼衰的诊断（PaO₂＜60mmHg，PaCO₂＞50mmHg），根据其临床表现和辅助检查，可初步诊断为慢性支气管炎急性加重，伴发Ⅱ型呼吸衰竭。因此首选的检查为人工机械通气（E对）。静脉滴注尼可刹米（A错）（P144）为呼吸兴奋剂，主要适用于以中枢抑制为主、通气量不足引起的呼吸衰竭，不宜用于以肺换气功能障碍为主所致的呼吸衰竭，但近年来该药物在西方国家几乎已被淘汰。静脉滴注毛花苷丙（B错）（P172）是强心药，适用于急性心力衰竭或慢性心衰加重期，但肺心病伴发低氧血症时慎用。酸中毒一般不静脉滴注4％碳酸氢钠（C错），防止反跳性碱中毒，当pH小于等于7.2时方可适量补碱。患者神志模糊，心率已达110次/分，提示进入休克失代偿期，不应静脉注射呋塞米（D错）利尿，以免加重休克。